初产妇，25岁。足月顺产后第3天，纯母乳喂养。乳房胀痛，无红肿，乳汁排出不畅，体温37.6℃。恰当的处理方法是
A. 生麦芽煎服
B. 少喝水
C. 让新生儿吸吮双乳
D. 抗生素治疗
E. 芒硝外敷用

正确答案：C。让新生儿吸吮双乳

解析：产后3～4天，出现乳房胀痛，乳汁排出不畅多由乳房过度充盈及乳腺管阻塞所致，让新生儿吸吮双乳（C对），可促进神经垂体分泌OT（缩宫素）。OT使乳腺腺泡周围的肌上皮细胞收缩，腺泡内压力升高，有利于乳汁排出。此外，哺乳前湿热敷3～5分钟，并按摩、拍打抖动乳房，更有利于乳汁的排出。少喝水（B错）可导致产妇水分摄入不足，并且不一定能减少乳汁分泌。生麦芽煎服（A错）及芒硝外敷用（E错）为退奶方法，仅在产妇不能哺乳时方考虑使用。产妇仅有乳房胀痛，而无局部红肿以及寒战、高热等感染中毒症状，不考虑急性乳腺炎，无需使用抗生素治疗（D错）。